指检可触及表面光滑，且圆软的肿物，可推动，考虑诊断为
A. 直肠癌
B. 直肠息肉
C. 内痔
D. 肛瘘
E. 肛裂

正确答案：B。直肠息肉

解析：指检可触及表面光滑，且圆软的重物，可推动，考虑诊断为直肠息肉（B对）。指诊时触及坚硬凹凸不平的包块应考虑直肠癌（A错）。内痔多较柔软不易扪及，除非有血栓形成（C错）。能够扪到硬结样内口及条索样瘘管为肛瘘（D错）。指诊时有强烈触痛的考虑为肛裂（E对）。